对细菌感染的急性腹泻者宜选用
A. 胰酶
B. 山莨菪碱
C. 双歧三联活菌制剂
D. 匹维溴铵
E. 左氧氟沙星

正确答案：E。左氧氟沙星

解析：本题考查腹泻用药。对细菌感染的急性腹泻者宜选用左氧氟沙星（E对）。左氧氟沙星为喹诺酮类抗菌药，可用于细菌感染的急性腹泻。胰酶（A错）可用于治疗因胰腺功能不全引起的消化不良性腹泻。山莨菪碱（B错）在腹痛较重或反复呕吐腹泻者腹痛剧烈时使用。双歧三联活菌制剂（C错）用于肠道菌群失调性腹泻。匹维溴铵（D错）适用于以腹泻为主要症状的肠易激综合征者。